关于强心苷，哪项错误
A. 有正性肌力作用
B. 有正性心肌传导功能
C. 有负性频率作用
D. 安全范围小
E. 用于治疗心衰，也可治疗室上性心动过速

正确答案：B。有正性心肌传导功能